麻疹的传染源
A. 山羊
B. 狗
C. 人
D. 鼠和猪
E. 鼠

正确答案：C。人

解析：本题考查麻疹的传染源。麻疹的传染源是人（C对ABDE错）。